细胞性牙骨质的沉积以补偿牙冠的磨耗发生于
A. 牙颈部
B. 牙冠1/3
C. 牙根中1/3
D. 牙根尖1/3
E. 牙髓腔

正确答案：D。牙根尖1/3

解析：在正常情况下，根尖1/3不断有细胞性牙骨质的沉积，以补偿牙冠的磨耗。掌握“根尖周病概述”知识点。